男婴，8个月，腹泻2个月，出生体重3.5kg，现体重6.8kg，血清总蛋白45g/L，白蛋白25g/L，最可能出现的体征是
A. 凹陷性水肿
B. 颅骨软化
C. 手、足镯
D. 方颅
E. 皮下脂肪消失

正确答案：E。皮下脂肪消失

解析：患儿腹泻2个月（营养丢失诱因），8个月现体重6.8kg（低于正常8.5kg），血清总蛋白45g/L，白蛋白25g/L（蛋白含量低），最可能的疾病诊断是营养不良，最可能出现的体征是皮下脂肪消失（E对）。当血清总蛋白浓度＜40g/L、白蛋白＜20g/L时，可有凹陷性水肿（A错）。颅骨软化（B错），手、足镯（C错），方颅（D错）见于维生素D缺乏性佝偻病（P77）。